有关空气湍流的论述哪些是错误的
A. 空气不规则流动称为湍流
B. 湍流风速大小不定，具有阵发性
C. 地面起伏大，气温垂直递减率越大，湍流运动越强
D. 湍流强，有利于污染物的稀释和扩散
E. 湍流强，不利于污染物自净

正确答案：E。湍流强，不利于污染物自净

解析：本题考查空气湍流的相关内容。空气湍流是一种大气的不规则流动（A对），风速大小不定，具有阵发性（B对）。地面起伏大，气温垂直递减率越大，湍流运动越强（C对）。湍流强，有利于污染物的稀释和扩散（D对），有利于污染物自净（E错，为本题正确答案）。